血虚证可见
A. 头晕目眩
B. 面色淡白
C. 二者均有
D. 二者均无

正确答案：C。二者均有

解析：本题考查的是血虚证的临床表现。血虚证可见头晕目眩与面色淡白（C对）。血虚证的临床表现及辨证要点：血虚证的临床表现，常见面色苍白或萎黄，唇色淡白，头晕眼花，心悸失眠，手足发麻，妇女经行量少、愆期甚或经闭，舌质淡，脉细无力。一般以面色、口唇、爪甲失其血色及全身虚弱为辨证要点。